治水肿伴心悸失眠，宜选的药是
A. 茯苓
B. 朱砂
C. 磁石
D. 泽泻
E. 薏苡仁

正确答案：A。茯苓

解析：本题考查的是茯苓的主治病证。治水肿伴心悸失眠，宜选的药是茯苓（A对）。茯苓：【主治病证】（1）小便不利，水肿，痰饮。（2）脾虚证，兼便溏或泄泻者尤佳。（3）心悸，失眠。朱砂（B错）：【主治病证】（1）心火亢盛之心神不安、胸中烦热、惊悸不眠，癫狂，癫痫。（2）疮疡，咽痛，口疮。磁石（C错）：【主治病证】（1）心神不宁，心悸失眠，惊风癫痫。（2）肝阳上亢，头晕目眩。（3）耳鸣，耳聋，目昏。（4）肾虚喘促。泽泻（D错）：【主治病证】（1）小便不利，水肿，淋浊，带下。（2）湿盛泄泻，痰饮。薏苡仁（E错）：【主治病证】（1）小便不利、水肿、脚气肿痛。（2）脾虚泄泻。（3）湿温病邪在气分。（4）湿痹筋脉拘挛。（5）肺痈，肠痈。